乳腺癌术后必须辅以放疗化疗的术式是
A. 乳腺癌根治术
B. 乳腺癌扩大根治术
C. 乳腺癌改良根治术
D. 保留乳房的乳腺癌切除术
E. 全乳房切除术

正确答案：D。保留乳房的乳腺癌切除术

解析：保留乳房的乳腺癌切除术（D对）仅包括完整切除肿块及腋淋巴结清扫，手术切除范围小，保留了乳房，但术后须辅以放疗、化疗。术后放疗可以减少局部复发；术后化疗可杀灭术时已存在的亚临床转移灶并能够减少因手术操作而引起的肿瘤播散。乳腺癌根治术（A错）、乳腺癌扩大根治术（B错）、乳腺癌改良根治术（C错）、全乳房切除术（E错）均切除了全部乳房，术后是否进行放化疗须根据有无指征。